下列何项不是重度子痫前期的标志
A. 血压＞21.3/14，7kPa（160/110mmHg）
B. 24小时尿蛋白定量大于等于5g
C. 头痛，视力障碍
D. 下肢水肿（+++）
E. 眼底动脉痉挛伴有视网膜水肿

正确答案：D。下肢水肿（+++）

解析：水肿不是重度子痫前期的必备表现，有时轻度子痫前期也可能有高度的水肿。掌握“娠期高血压疾病”知识点。